医师履行职责应受全社会尊重受法律保护体现的是
A. 医师的权利
B. 医师的义务
C. 医师的职责
D. 医师的社会地位
E. 医师的执业条件

正确答案：D。医师的社会地位

解析：医师履行职责应受全社会尊重受法律保护体现的是医师的社会地位（D对）。